利用前药修饰原理，增加药物的稳定性
A. 丙酸睾丸素
B. 头孢孟多酯钠
C. 氯霉素棕榈酸酯
D. 头孢美唑的新戊酰氧甲基酯
E. 赛达明

正确答案：B。头孢孟多酯钠